胃大部切除术后发生残胃癌的最短时间是术后
A. 1年
B. 5年
C. 10年
D. 20年
E. 15年

正确答案：B。5年

解析：由残胃癌的定义可知，胃大部切除术后发生残胃癌的最短时间是术后5年（B对）。此外，临床上多数病人的残胃癌发生于胃大部切除术后10年以上。